对精神分裂症最具诊断价值的是
A. 注意力不集中
B. 急性发病
C. 人格改变
D. 情绪低落
E. 妄想知觉

正确答案：E。妄想知觉

解析：精神分裂症约占半数是偏执型，以相对稳定的妄想（E对）为主要的临床表现，往往伴有幻觉（特别是幻听）（E对）。精神分裂症多中年起病，缓慢发展（B错），初起敏感多疑逐渐发展成妄想，以关系、被害妄想最多见。